过敏性结膜炎者宜选用的滴眼剂是
A. 碘苷
B. 硫酸锌
C. 利福平
D. 色甘酸钠
E. 磺胺醋酰钠

正确答案：D。色甘酸钠

解析：本题考查滴眼剂。过敏性结膜炎者宜选用的滴眼剂是色甘酸钠（D对）。急性结膜炎（火眼或红眼病）是发生在结膜上的一种急性感染，常见急性卡他性结膜炎（肺炎双球菌、流感杆菌、葡萄球菌等）、过敏性结膜炎（过敏）、流行性结膜炎（腺病毒）及流行性出血性结膜炎（腺病毒70型）。常用的治疗急性结膜炎的药物包括非处方药和处方药两种。1.非处方药 （1）细菌感染的急性卡他性结膜炎：四环素、金霉素、红霉素、利福平（C错）、杆菌肽眼膏、酞丁安、磺胺醋酰钠滴眼液（E错）。（2）流行性结膜炎局部给予抗病毒药：0.1%酞丁安、阿昔洛韦滴眼液。（3）过敏性结膜炎：醋酸可的松、醋酸氢化可的松、色甘酸钠滴眼液。（4）春季卡他性结膜炎可应用2%色甘酸钠滴眼液。2.处方药 （1）铜绿假单胞性结膜炎病情较严重，必须及早治疗：多黏菌素B、磺苄西林滴眼液。真菌性角膜炎：两性霉素B、克霉唑滴眼液。（2）急性卡他性结膜炎未彻底治愈而转成慢性结膜炎，由细菌所致的结膜炎：诺氟沙星、左氧氟沙星滴眼液、四环素眼膏；由环境（灰尘等）刺激所致的结膜炎以对症为主：0.5%硫酸锌滴眼液（B错）。（3）流行性结膜炎：0.1%碘苷滴眼液（A错）。（4）流行性出血性结膜炎：0.1%羟苄唑、0.1%利巴韦林滴眼液。（5）春季卡他性结膜炎：1%泼尼松滴眼液。